女，25岁，心悸，气促下肢水肿4年。望诊心脏负性心尖搏动，已排除粘连性心包炎。心脏听诊时，该病人最重要的体征为
A. 心尖区舒张期杂音
B. 心尖区收缩期杂音
C. 主动脉瓣区舒张期杂音
D. 心尖区一心音亢进
E. 肺动脉瓣区二心音分裂

正确答案：B。心尖区收缩期杂音